下列哪项不是慢性龋的特点
A. 只见于成年人
B. 病变进展慢
C. 病变组织颜色深
D. 病变组织质地较干硬
E. 去腐时不易大块去除

正确答案：A。只见于成年人

解析：本题考查慢性龋的特点。慢性龋，不止见于成年人（A错，为本题的正确答案），青少年及老年人也可发生。慢性龋病程进展缓慢（B对），病变组织颜色较深（C对），呈黑褐色。慢性龋在长期缓慢的病变发展过程中，病变组织发生一定程度的再矿化，因而病变组织质地较干硬（D对），去腐时不易大块去除（E对）。